杀死包括芽胞在内所有微生物的方法称为
A. 消毒
B. 无菌
C. 防腐
D. 灭菌
E. 抑菌

正确答案：D。灭菌

解析：灭菌指杀灭物体上所有微生物，包括病原微生物（细菌、真菌和病毒）、非病原微生物和芽孢（胞）的方法。掌握“消毒与灭菌”知识点。